恶性疟疾患者常见
A. 血红蛋白尿
B. 酱油色尿
C. 乳糜尿
D. 淡黄色尿
E. 浓茶色尿

正确答案：B。酱油色尿

解析：疟疾是由雌性按蚊叮咬人体将其体内寄生的疟原虫传入人体所引起的寄生虫病。临床上以间歇性寒战、高热，继之大汗后缓解为特点。反复发作后，多有贫血及脾大。脑型疟多在发作数日后，出现神志不清、抽搐和昏迷。较严重者出现寒战、腰痛、酱油色尿（B对）等急性血管内溶血症状，甚至发生急性肾衰竭。血红蛋白尿（A错）多由溶血性疾病、肾病及药物等导致。乳糜尿（C错）为斑氏丝虫病常见的晚期临床表现。淡黄色尿（D错）为正常的小便性状。浓茶色尿（E错）常由肝胆系疾病及药物导致。